属于二肽基肽酶-4（DPP-4）抑制剂的药物是
A. 西格列汀
B. 那格列奈
C. 格列美脲
D. 利拉鲁肽
E. 罗格列酮

正确答案：A。西格列汀

解析：本题考查降糖药的分类。降糖药的分类：①磺酰脲类促胰岛素分泌剂：格列本脲、格列吡嗪、格列齐特、格列美脲（C错）；②非磺酰脲类促胰岛素分泌剂：瑞格列奈、那格列奈（B错）、米格列奈；③二肽基肽酶-4抑制剂：西格列汀（A对）、沙格列汀、阿格列汀、维格列汀、利格列汀；④双胍类：二甲双胍；⑤噻唑烷二酮类胰岛素增敏剂：吡格列酮、罗格列酮（E错）；⑥α-葡萄糖苷酶抑制剂：阿卡波糖、伏格列波特、米格列醇；⑦钠-葡萄糖协同转运蛋白-2抑制剂：达格列净、恩格列净、卡格列净。利拉鲁肽（D错）是胰高血糖素样肽-1受体激动剂。